女，30岁。妊娠33周，反复阴道流血3次，量少于月经量，无腹痛不适，臀位。胎心正常，G8P3，曾人工流产4次。目前应采取的处理措施是
A. 抗感染
B. 抑制宫缩
C. 前列腺素引产
D. 立即剖宫产
E. 静滴缩宫素引产

正确答案：B。抑制宫缩

解析：妊娠晚期妇女，既往有多次流产史、多孕产次（前置胎盘高危因素），反复阴道流血，无腹痛不适，胎位清楚。据患者生育史、临床表现及查体，最可能的诊断是前置胎盘。治疗以抑制宫缩、纠正贫血、预防感染和适时终止妊娠为原则。该产妇妊娠＜36周，出血量少、胎儿存活正常，一般情况良好，阴道流血少，且无需紧急分挽，用期待疗法，抑制宫缩（B对）防止进一步出血即可。